天王补心丹与朱砂安神丸组成中均含有的药物是
A. 酸枣仁
B. 炙甘草
C. 玄参
D. 黄连
E. 生地

正确答案：E。生地

解析：天王补心丹组成为酸枣仁、柏子仁、当归、天冬、麦冬、生地、人参、丹参、玄参、白茯苓、五味子、远志、桔梗、朱砂（补心丹用柏枣仁，二冬生地当归身，三参桔梗朱砂味，远志茯苓共养神），朱砂安神丸组成为朱砂、甘草、黄连、当归、生地（朱砂安神东恒方，归连甘草合地黄，怔忡不寐心烦乱，养阴清热可复康）（E对）。